注意力缺陷多动障碍的治疗原则是
A. 调和阴阳
B. 补益心脾
C. 滋肾平肝
D. 补益心脾
E. 清心化痰

正确答案：A。调和阴阳

解析：注意力缺陷多动障碍的中医病因病机为先天禀赋不足、后天调护不当、产伤外伤、情志失调等均可导致小儿阴阳失于平秘，发为本病。主要发病机制为阴阳平衡失调，即阳动有余，阴静不足，阴不制阳，阳失制约则兴奋多动。《素问·生气通天论》云∶"阴平阳秘，精神乃治。"人的正常精神情志活动，是阴阳保持协调统一的结果。小儿阴常不足，阳常有余。若先天不足、后天失调或他病所伤，最易形成阴亏阳亢的病理变化，因此本病的治疗原则为调和阴阳（A对）。